患者戴用全口义齿1周后，自诉义齿易松动。检查诊断程序是
A. 先检查咬合是否稳定
B. 先让患者吃一样东西试试
C. 先检查固位力如何
D. 先让病人张大嘴
E. 先让病人打哈欠

正确答案：C。先检查固位力如何

解析：本题考查固位不良的检查诊断程序。全口义齿易松动即固位不良。固位不良的原因是多方面的。一方面是由于患者口腔条件差，另一方面是由于义齿本身的问题造成。在对患者进行检查时，应先检查义齿的固位力如何（C对），由此判断是患者本身的原因还是义齿不合适造成的。而检查咬合是否稳定（A错）、让患者吃一样东西试试（B错）、让病人张大嘴（D错）、让病人打哈欠（E错）等都是用来检查义齿的适合性，应在排除患者本身的原因以后再进行。